款冬花的性状鉴别特征有
A. 呈长圆棒状
B. 常2～3个花序连在一起，习称“连三朵”
C. 苞片外表面紫红色，内表面密被白色絮状茸毛
D. 体重，撕开后显粉性
E. 气清香，味微苦而辛

正确答案：A、B、C、E。呈长圆棒状；常2～3个花序连在一起，习称“连三朵”；苞片外表面紫红色，内表面密被白色絮状茸毛；气清香，味微苦而辛

解析：本题考查的是款冬花药材的性状鉴别。款冬花的性状鉴别特征有呈长圆棒状（A对）、常2～3个花序连在一起，习称“连三朵”（B对）、苞片外表面紫红色，内表面密被白色絮状茸毛（C对）与气清香，味微苦而辛（E对）。款冬花：【性状鉴别】药材呈长圆棒状。常单生或2～3个基部连生。上端较粗，下端渐细或带有短梗，外面被有多数鱼鳞状苞片，习称“连三朵”。苞片外表面紫红色或淡红色，内表面密被白色絮状茸毛。体轻，撕开后可见白色茸毛（D错）。气清香，味微苦而辛。